治疗咳血肝火犯肺证，应首选
A. 百合固金汤
B. 泻心汤
C. 泻白散
D. 知柏地黄丸
E. 龙胆泻肝汤

正确答案：C。泻白散

解析：“咳血诊断依据为血由肺、气道而来，经咳嗽而出，或觉喉痒胸闷，一咯即出，血色鲜红，或夹泡沫，或痰血相兼，痰中带血”，咳血之肝火犯肺证，其证候为“咳嗽阵作，痰中带血或纯血鲜红，胸胁胀痛，烦躁易怒，口苦，舌红苔薄黄，脉弦数”，治以清肝泻火，凉血止血，代表方为泻白散合黛蛤散，根据最佳选项的原则，仍选择泻白散清泄肺热（C对）。百合固金汤，其功用为滋养肺肾，止咳化痰，与秦艽鳖甲散合用，可用于治疗肺痨之虚火灼肺证（A错）。(B错)。知柏地黄丸，其功用为滋阴降火，可用于早泄之阴虚火旺证（D错）。龙胆泻肝汤，其功用为清泻肝胆实火，清利肝胆湿热，可用于不寐之肝火扰心证、鼻衄之肝火上炎证或吐血之肝火犯胃证（E错）。